乌贼骨不具有的功效是
A. 收敛止血
B. 温中行气
C. 固精止带
D. 制酸止痛
E. 收湿敛疮

正确答案：B。温中行气

解析：本题考查乌贼骨的功效。乌贼骨不具有的功效是温中行气（B错，为本题正确答案）。海螵蛸【来源】乌贼科动物曼氏无针乌贼或金乌贼的干燥内壳。【功效】收敛止血，固精止带，制酸止痛，收湿敛疮。